真空高温高压灭菌法时温度通常要达到
A. 130℃
B. 131℃
C. 132℃
D. 133℃
E. 134℃

正确答案：C。132℃

解析：真空高温高压灭菌法：利用机械抽真空的方法，使灭菌柜室内形成负压，蒸汽得以迅速穿透到物品内部进行灭菌。蒸汽压力达205.8kPa（2.1kg/cm2），温度达132℃或以上开始灭菌，到达灭菌时间后，抽真空使灭菌物品迅速干燥。掌握“口腔器械的消毒与灭菌及医疗废物处理”知识点。